急性重症胰腺炎的临床表现一般不包括
A. 休克
B. 呼吸衰竭
C. 发热
D. 腹泻
E. 消化道出血

正确答案：D。腹泻

解析：急性重症胰腺炎因大量炎性渗出、严重炎症反应及感染，可出现发热（C对）、低血压甚至休克（A对）；严重炎症反应可致肺间质水肿、成人呼吸窘迫综合症引起呼吸衰竭（B对）；应激性溃疡致消化道出血（E对）。胰腺出血坏死、渗出，致移动性浊音阳性、肠鸣音减少甚至消失，故不会出现腹泻（D错，为本题正确答案）。慢性胰腺炎时，可因胰腺外分泌功能明显不足而出现腹泻（P436）。